两牙之间的牙槽骨是
A. 牙槽骨
B. 牙槽窝
C. 牙槽嵴
D. 牙槽间隔
E. 牙根间隔

正确答案：D。牙槽间隔

解析：牙槽间隔：两牙之间的牙槽骨。掌握“上颌骨解剖特点”知识点。